46岁男性，因乏力就诊，血红蛋白为68g/L，血压为156/94mmHg，血肌酐为386μmol/L。其诊断是
A. 贫血
B. 高血压
C. 慢性肾功能不全
D. 急性肾功能不全
E. 营养不良

正确答案：C。慢性肾功能不全

解析：慢性肾功能不全的诊断要点：肾小球滤过率（GFR）＜90mL/（min·173㎡），或Ccr＜80mL/min，cr＞133μmol/L，有慢性原发或继发性肾脏疾病病史。根据本病患者乏力，血压为156/94mmHg（收缩压≥140mmHg和（或）舒张压≥90mmHg），实验室检查：血红蛋白为68g/L（＜120g/L），肌酐为386μmol/L（Scr＞133μmol/L）可诊断为慢性肾功能不全（C对）；该患者虽然有贫血症状，但Scr＞133μmol/L（A错）；该患者虽然为高血压，但Scr＞133μmol/L（B错）；急性肾功能不全的临床症状为肾功能突然下降、尿量减少甚至无尿（D错）；营养不良的症状为消瘦，皮肤弹性下降，精神倦怠、容易疲乏，部分患者可有凹陷性水肿等（E错）。